男，40岁，右下第一磨牙死髓牙，经根管治疗后以PFM全冠修复，经牙体制备取模后，在全冠初戴之前，尚需作何种处理
A. 不需做任何处理
B. 用塑料全冠作暂时保护性修复
C. 用金属全冠作保护性修复
D. 制作活动义齿保持间隙
E. 制作间隙保持器

正确答案：B。用塑料全冠作暂时保护性修复

解析：本题考查暂时修复体。死髓牙牙体组织易发生折断，尤其经过牙体预备后，预备体体积明显减小，牙折的可能性更大，因此在全冠初戴之前，用塑料全冠作暂时保护性修复（B对），不能不做任何处理（A错）。金属全冠用于永久修复（C错）。塑料全冠暂性修复体也有维持间隙、防止邻牙倾斜、防止对颌牙伸长的功能，无需再制作活动义齿（D错）或间隙保持器（E错）。